女孩6岁，反复喘息发作2年，近3天又出现喘息发作，双肺广泛哮鸣音，考虑诊断支气管哮喘，此病与过敏性肺炎不同点主要为
A. 有过敏原接触史
B. 血中嗜酸粒细胞增高
C. 喘息
D. 致敏原
E. 胸部X线表现

正确答案：E。胸部X线表现

解析：支气管哮喘和过敏性肺炎的不同点主要为胸部X线表现（E对），支气管哮喘发作时胸部 X 线可见两肺透亮度增加，缓解期多无明显异常。过敏性肺炎胸部X线片可见弥漫分布的磨玻璃样，甚至粟粒样阴影。两者都可存在过敏原接触史（A错），血中嗜酸粒细胞增高（B错）、喘息（C错）、致敏原（D错）。